绿化的卫生学意义包括
A. 绿色植物是生命之源
B. 绿色是良好生态环境的象征
C. 绿色植物是生物多样性的一部分
D. 绿色植物具有经济价值
E. 调节和改善小气候、净化空气、降低噪声

正确答案：E。调节和改善小气候、净化空气、降低噪声

解析：本题考查绿化的卫生学意义。城市绿化是在城市中栽种植物和利用自然条件以改善城市生态、保护环境、为居民提供游憩场地和美化城市景观的活动。绿化的卫生学意义包括：1.调节和改善小气候；2.净化空气，降低噪声（E对ABCD错）；3.对人类有良好的生理和心理作用；4.可减少地表径流，减缓暴雨积水，涵养水源，蓝水防洪；5.具有减灾功能，如减轻雪崩、滑坡、泥石流等灾害；6.有利于水土保持。